涎腺多形性腺瘤之所以称为混合瘤是因为
A. 此肿瘤多为良性，但少数可恶变
B. 肿瘤内既有唾液腺上皮，又有鳞状上皮及柱状上皮
C. 肿瘤内既有唾液腺上皮，又有黏液或软骨样组织
D. 肿瘤内腺上皮细胞的核型多样化
E. 肿瘤的临床表现多样化

正确答案：C。肿瘤内既有唾液腺上皮，又有黏液或软骨样组织

解析：本题考查多形性腺瘤。多形性腺瘤内既有唾液腺上皮，又有黏液或软骨样组织（C对B错）。肿瘤多为良性但少数可恶变，是多形性腺瘤称为临界瘤的原因（A错）。多形性腺瘤腺上皮呈立方形或矮柱状，核圆形或卵圆形（D错）。临床表现：以30～60岁多见，女性多于男性，好发于腮腺，其次为下颌下腺，舌下腺罕见。小唾液腺以腭部多见，为生长缓慢的无痛肿块，不规则形，表面有结节，软硬不一，可活动，腭部及多次复发者一般不活动，腭部肿物较大可伴创伤性溃疡（E错）。